关于内毒素性质的错误叙述是
A. 来源于革兰阴性菌
B. 用甲醛脱毒可制成类毒素
C. 其化学成分是脂多糖
D. 性质稳定，耐热
E. 菌体死亡裂解后释放

正确答案：B。用甲醛脱毒可制成类毒素

解析：内毒素的主要特点有：①产生于革兰阴性菌细胞壁（A对），只有在细菌死亡裂解后才被释放出来（E对）；②化学性质是脂多糖（LPS）（C对）；③对理化因素稳定，耐热（D对），难以用加热方法使其灭活④毒性作用相对较弱且对组织无选择性；⑤不能用甲醛液脱毒而成为类毒素（B错，为本题正确答案）。可以甲醛液脱毒而成为类毒素的是外毒素。